甲状腺功能减退症患者有严重的智力低下、聋哑，估计其甲状腺功能减退始于
A. 胎儿期或新生儿期
B. 3～5岁
C. 6～10岁
D. 11～17岁
E. 18岁以后

正确答案：A。胎儿期或新生儿期

解析：甲状腺激素对中枢神经系统的发育的影响很大，胎儿期或新生儿期甲状腺功能减退症患者可有严重的共济失调、聋哑、智力低下等（A对），生长发育期甲状腺功能减退可出现“呆小症”，成人甲状腺功能减退会导致黏液性水肿。